将统计分析的事物及其指标的内容用表格形式来表达
A. 方差
B. 柱状图
C. 统计表
D. 饼形图
E. 均值

正确答案：C。统计表

解析：统计表是将统计分析的事物及其指标的内容用表格形式来表达。它可代替冗长的文字叙述，便于计算、分析和对比。可分为简单表和复合表。掌握“统计表和统计图”知识点。